下列有关羊乳的相关叙述中，不恰当的是
A. 羊乳其成分与牛乳相仿
B. 羊乳叶酸含量很高
C. 羊乳维生素B12含量少
D. 羊乳喂养者应添加维生素B12
E. 羊乳喂养者可引起巨幼细胞贫血

正确答案：B。羊乳叶酸含量很高

解析：羊乳其成分与牛乳相仿。但其叶酸含量极低，维生素B12也少，故羊乳喂养者应添加叶酸和维生素B12，否则可引起巨幼细胞贫血。掌握“婴儿喂养方法”知识点。